癫痫复杂部分性发作的病灶多位于
A. 额叶
B. 脑干
C. 颞叶
D. 枕叶
E. 基底节

正确答案：C。颞叶

解析：癫痫复杂部分性发作病灶多在颞叶（C对），因而也叫颞叶癫痫，也见于额叶（A错），但不多见。枕叶（D错）病损主要引起视觉障碍，枕叶癫痫主要表现为伴有视觉症状的单纯部分性发作。脑干（B错）和基底节（E错）部位的病灶可以出现癫痫症状，但不是癫痫复杂部分性发作的常见病灶。